根尖肉芽肿内增生上皮团或条索来源于
A. Malassez上皮剩余
B. 经窦道口长入的口腔上皮
C. 牙周袋袋壁上皮
D. 呼吸道上皮
E. 以上均是

正确答案：E。以上均是

解析：本题考查根尖周肉芽肿。根尖肉芽肿内增生上皮团或条索可来源于Malassez上皮剩余（A对）、经窦道口长入的口腔上皮（B对）、牙周袋袋壁上皮（C对）、呼吸道上皮（D对）（ABCD均对，E为本题的正确答案）。